可引起急性肾小管坏死的药物是
A. 阿司匹林
B. 磺胺甲噁唑
C. 卡托普利
D. 奎尼丁
E. 两性霉素B

正确答案：E。两性霉素B

解析：本题考查药源性疾病。可引起急性肾小管坏死的药物是两性霉素B（E对）；阿司匹林（A错）等非甾体抗炎药对肾脏的作用主要表现在可引起急性间质性肾炎、慢性间质性肾炎、肾小球肾炎、慢性肾功能衰竭等；磺胺甲噁唑（B错）对肾脏的作用主要表现在可引起梗阻性急性肾功能衰竭；卡托普利（C错）可引起肾功能损害、肾病综合征、肾小球肾炎等；奎尼丁（D错）可引起尖端扭转性室性心动过速。